某男，54岁。1年前，爪甲菲薄发软，影响工作。虽多方求治但收效不大。刻下面黄，夜寐多梦，时有头晕心慌，纳食与二便正常；舌淡红苔薄白脉细沉。血红蛋白偏低。医师诊为肝血不足、筋爪失养治养血补肝益筋。药用熟地黄12g、山茱萸10g、当归10g、炒白芍10g、五味子5g打碎、阿胶珠10g、炒酸枣仁15g打碎、川芎5g、木瓜10g、生牡蛎30g打碎先煎、夜交藤15g。10剂每日1剂水煎分2次服。以此方加减治疗数月爪甲复常。方中均性平而具养心安神的药组是
A. 炒酸枣仁、生牡蛎
B. 五味子、夜交藤
C. 炒酸枣仁、夜交藤
D. 五味子、生牡蛎
E. 生牡蛎、川芎

正确答案：C。炒酸枣仁、夜交藤

解析：本题考查的是酸枣仁与夜交藤的功效。方中均性平而具养心安神的药组是炒酸枣仁、夜交藤（C对）。酸枣仁：【功效】养心安神，敛汗。夜交藤：【功效】养心安神，祛风通络。牡蛎（ADE错）：【功效】平肝潜阳，镇惊安神，软坚散结，收敛固涩，制酸止痛。五味子（B错）：【功效】收敛固涩，益气生津，滋肾宁心。川芎：【功效】活血行气，祛风止痛。